对诊断肥厚性梗阻性心肌病最有意义的是
A. 心电图出现深而宽的病理性Q波
B. 胸骨左缘第三、四肋间有响亮的收缩期杂音
C. 用力时心前区闷痛及晕厥史
D. 超声心动图发现舒张期室间隔与左室后壁的厚度之比≥1.3，伴二尖瓣前叶收缩期向前运动
E. 可闻及第三心音及第四心音

正确答案：D。超声心动图发现舒张期室间隔与左室后壁的厚度之比≥1.3，伴二尖瓣前叶收缩期向前运动

解析：超声心电图是临床诊断肥厚型梗阻性心肌病最主要的手段。特征性表现为心室不对称肥厚而无心室腔增大，且舒张期室间隔与左室后壁厚度之比≥1.3，伴二尖瓣前叶收缩期向前运动（D对）。心电图出现深而宽的病理性Q波（A错）多见于心肌梗死患者（P237），仅有少数肥厚型梗阻性心肌病患者可出现深而不宽的病理性Q波。胸骨左缘第三、四肋间有响亮的收缩期杂音（B错）可见于先天性室间隔缺损（P273）；用力后心前区闷痛及晕厥史（C错）可见于主动脉瓣狭窄（P295）；可闻第三心音及第四心音（E错）能见于扩张型心肌病（P262），后三种症状或体征虽然都能出现在肥厚型梗阻性心肌病患者，但都不具有诊断特异性。